患者，男，72岁，既往有高血压、心绞痛、心力衰竭、房室传导阻滞和胃溃疡病史。一个月前，因出现哮喘症状就诊，医师处方布地奈德气雾剂200㎍bid吸入，沙丁胺醇气雾剂100㎍prn吸入，氨氯地平片5mgqd口服及硝酸甘油片0.5mgprn舌下含服治疗。药师在用药指导时，应告知患者布地奈德气雾剂正确的使用步骤是
A. 漱口→摇匀→呼气→揿压阀门并深吸气→屏气约10s
B. 呼气→摇匀→揿压阀门并深吸气→屏气约10s→漱口
C. 摇匀→呼气→深吸气同时揿压阀门→屏气约10s→漱口
D. 呼气→揿压阀门并深吸气→屏气约10s→漱口
E. 摇匀并揿压阀门→呼气→深吸气→屏气约10s→漱口

正确答案：C。摇匀→呼气→深吸气同时揿压阀门→屏气约10s→漱口

解析：本题考查气雾剂的正确使用。药师在用药指导时，应告知患者布地奈德气雾剂正确的使用步骤是：摇匀→呼气→深吸气同时揿压阀门→屏气约10s→漱口（C对）。使用气雾剂时，宜按下列步骤进行：①尽量将痰液咳出，口腔内的食物咽下；②用前将气雾剂摇匀；③将双唇紧贴近喷嘴，头稍微后倾，缓缓呼气尽量让肺部的气体排尽；④于深呼吸的同时揿压气雾剂阀门，使舌头向下；准确掌握剂量，明确1次给药揿压几下；⑤屏住呼吸约10～15s，后用鼻子呼气；⑥含激素类制剂用温水漱口。